在糖尿病筛检方案中，甲试验血糖筛检标准定为160mg/ml，乙试验定为130mg/ml，比较甲乙试验时哪种说法是不正确的
A. 甲试验的灵敏度低于乙试验
B. 乙试验的特异度低于甲试验
C. 甲试验的假阴性率比乙试验高
D. 甲试验的阳性预测值比乙试验低
E. 乙试验的误诊率比甲试验高

正确答案：D。甲试验的阳性预测值比乙试验低

解析：本题考查阳性预测值。甲试验血糖筛检标准定为160mg/ml，乙试验定130mg/ml，根据阳性预测值定义，甲试验的阳性预测值比乙试验高（D错，为本题正确答案），即甲试验筛检发现的阳性者中患目标疾病的人所占的比例较多。此外，甲试验的灵敏度低于乙试验（A对）；乙试验的特异度低于甲试验（B对）；甲试验的假阴性率比乙试验高（C对）；乙试验的误诊率比甲试验高（E对）。